Wilson曲线又可称为
A. 上颌牙列的纵（牙合）曲线
B. 下颌牙列的纵（牙合）曲线
C. Spee曲线
D. 横（牙合）曲线
E. 补偿曲线

正确答案：D。横（牙合）曲线

解析：横（牙合）曲线又称Wilson曲线。掌握“牙列”知识点。